根据《关于城镇医药卫生体制改革的指导意见》，把医院的门诊药房改为药品零售企业，独立核算，照章纳税，要解决的主要问题是
A. 医疗服务价格
B. 医疗机构药品采购方式
C. 以药养医
D. 药品价格过高
E. 药品招标采购

正确答案：C。以药养医